患者，女，55岁，诊断为“甲癣”宜使用的药物是
A. 卡泊芬净
B. 氟胞嘧啶
C. 特比萘芬
D. 氟康唑
E. 制霉菌素

正确答案：C。特比萘芬

解析：本题考查特比萘芬。“甲癣”宜使用的药物是特比萘芬（C对）。卡泊芬净（A错）抑制许多丝状真菌和酵母菌细胞壁的一种基本成份-β（1，3）-D-葡聚糖的合成，从而发挥抗真菌的作用。氟胞嘧啶（B错）对念珠菌属、隐球菌属和部分暗色真菌等有抗菌作用，因其极易产生耐药性，极少单独用药，主要与两性霉素B、氟康唑或伊曲康唑等联合应用治疗隐球菌病和深部念珠菌病。氟康唑（D错）为广谱抗真菌药，对人和动物的真菌感染均有治疗作用。制霉菌素（E错）具有共轭多烯大环内酯结构，能抑制真菌和皮藓菌的活性，对细菌无抑制作用，对空气、光、热、水、酸或碱均不稳定。